女性28岁。已婚3年未孕，月经规律4～5/（28～30）天，量中，近2年痛经（+），妇科检查：宫颈糜烂Ⅰ°，子宫后倾，正常大小，活动度差。左侧附件可扪及8cm×8cm×6cm囊性肿块轻压痛。右附件（-）。B超检查：左侧卵巢囊肿。诊断为左侧卵巢巧克力囊肿。该患者选用的治疗方法
A. 高效孕激素周期疗法
B. 经期用消炎痛对症治疗
C. 假孕疗法
D. 假绝经疗法
E. 行左侧巧克力囊肿切除术

正确答案：E。行左侧巧克力囊肿切除术

解析：28岁女性患者，诊断为左侧卵巢巧克力囊肿，考虑囊肿大小、患者年龄和生育要求，该患者选用的治疗方法应为行左侧巧克力囊肿切除术（E对）。高效孕激素周期疗法（A错）、假孕疗法（C错）、假绝经疗法（D错）不适用于较大的卵巢内膜异位囊肿患者（P272-P273）。经期用消炎痛对症治疗（B错）只能缓解患者症状，不能去除病因，因此可作为辅助治疗措施，但不是最根本的治疗方法。